男，72岁，10年前因心肌梗死住院。5年前出现活动后气短，夜间憋醒，近1年双下肢水肿，少尿。查体：BP140/90mmHg，颈静脉怒张，双下肺可闻及细湿啰音，心界向两侧扩大，心率110次/分，肝肋下3cm，质中，压痛（+），双下肢水肿。该患者可能的诊断是
A. 右心衰竭
B. 全心衰竭
C. 心功能Ⅲ级（NYHA分级）
D. 左心衰竭
E. 心功能Ⅲ级（Killip分级）

正确答案：B。全心衰竭

解析：患者老年男性，活动后气短、夜间憋醒、双下肺可闻及细湿啰音（左心衰竭导致肺循环淤血的典型表现）；双下肢水肿、颈静脉怒张、肝大（右心衰竭导致体循环淤血的典型表现），由此判断该患者为全心衰竭（B对AD错）。心功能Ⅲ级（NYHA分级）（C错）指心脏病患者体力活动明显受限，低于平时一般活动即引起心衰症状。心功能Ⅲ级（killip分级）（E错）指急性心肌梗死引起的心衰，全肺干湿啰音大于肺野50%。